患者，女，28岁，体重80kg。12年前于颅脑外伤后出现癫痫全面强直-阵挛性发作，间断有失神发作，最初服用丙戊酸钠缓释片，后因效果不佳，陆续加用奥卡西平片、拉莫三嗪片，三药合用至今已3年；另外间断服用碳酸钙片、骨化三醇胶丸。因患者计划怀孕，需调整给药方案，应首先考虑更换的药物是
A. 奥卡西平片
B. 拉莫三嗪片
C. 丙戊酸钠缓释片
D. 碳酸钙片
E. 骨化三醇胶丸

正确答案：C。丙戊酸钠缓释片

解析：本题考查特殊人群用药。应首先考虑更换的药物是丙戊酸钠缓释片（C对）。丙戊酸钠缓释片具有致畸性，妊娠期妇女如需考虑应用可使用普通片。育龄期妇女可酌情选用奥卡西平（A错）、拉莫三嗪（B错）。碳酸钙片（D错）和骨化三醇（E错）是补钙和维生素D的，育龄期妇女可以使用。